下列关于多聚腺苷酸（polyA）尾巴特性叙述除外的是
A. 以无模板的方式添加
B. 可增加mRNA的稳定性
C. 维持mRNA的翻译活性
D. 长度为20～50个腺苷酸
E. 在基因的3’-端无多聚腺苷酸序列

正确答案：D。长度为20～50个腺苷酸

解析：3’-端绝大多数均带有多聚腺苷酸（polyA）尾巴，其长度为20～200个腺苷酸。PolyA尾巴是以无模板的方式添加的，因为在基因的3’-端并没有多聚腺苷酸序列。PolyA尾巴可以增加mRNA的稳定性，维持mRNA的翻译活性。掌握“RNA”知识点。